关于颞下颌关节的描述，何者正确
A. 由下颌头及下颌窝构成
B. 关节囊内有透明软骨构成的关节盘
C. 关节盘独立于关节腔，未与关节囊相连
D. 为联合关节，故两侧关节须同时运动
E. 关节囊后部较弱，故易向后脱位

正确答案：D。为联合关节，故两侧关节须同时运动

解析：颞下颌关节由下颌骨下颌头、颞骨下颌窝、关节结节组成（A错），颞下颌关节关节囊内有纤维软骨构成的关节盘（B错），周缘与关节囊相连（C错）将关节囊分为上下两部分，关节囊的前份薄弱，关节易向前脱位（E错）。颞下颌关节属于联合关节，两侧必须同时运动（D对）。